胎儿在子宫内急性缺氧初期表现为胎动
A. 减弱
B. 增强
C. 次数减少
D. 频繁
E. 次数稍增多

正确答案：D。频繁

解析：胎儿在子宫内因急性或慢性缺氧危及其健康和生命的综合症称为胎儿窘迫。胎儿在子宫内急性缺氧初期表现为胎动频繁（D对E错），继而胎动减弱（A错）及次数减少（C错）。胎儿在子宫内急性缺氧初期不会出现胎动增强（B错）。